依据五行学说，面见赤色，口味苦，脉洪，诊断为
A. 肝气郁结
B. 心火亢盛
C. 肝病乘脾
D. 肺热壅滞
E. 肝火犯肺

正确答案：B。心火亢盛

解析：本题考查的是五行学说临床应用。依据五行学说，面见赤色，口味苦，脉洪，诊断为心火亢盛（B对）。由于脏腑都具有五行属性，因此从面色、口味、脉象等外在表现，可以用来诊断脏腑疾病。例如，诊断本脏病：面见青色，喜食酸味，脉见弦象，诊断为肝病；面见赤色，口味苦，脉象洪，诊断为心火亢盛。诊断疾病传变：脾虚患者，脉见缓象，而面见青色，为木来乘土；心病患者，脉象洪，而面见黑色，为水来乘火等。并且，可以从色与脉之间的生克关系来判断疾病的预后。